男性，66岁。无痛性肉眼血尿伴条状血块2个月。B超可见左肾轻度积水。2次细胞学检查未见癌细胞。为进一步诊治下列哪项检查最有价值
A. 血常规，肝肾功能
B. CT增强+三维重建CTU
C. 膀胱镜检查
D. 膀胱造影
E. MRI

正确答案：B。CT增强+三维重建CTU

解析：老年男性患者，无痛性肉眼血尿伴条状血块（提示可能为上尿路肿瘤），B超示左肾轻度积水（提示左侧上尿路梗阻），结合患者临床表现和相关检查，应考虑为左侧上尿路肿瘤。CT增强+三维重建CTU最有价值。（B对）。血常规，肝肾功能（A错）为一般常规检查，不具有特异性。膀胱镜检查（C错）、膀胱造影（D错）多用于膀胱病变的诊断。MRI（E错）检查对上尿路肿瘤的诊断及与其他疾病的鉴别诊断有较好的应用价值，但费用昂贵，一般不作为首选。